胆囊动脉多从下列哪条动脉发出
A. 肝左动脉
B. 肝右动脉
C. 胃十二指肠动脉
D. 胃右动脉
E. 肠系膜上动脉

正确答案：B。肝右动脉

解析：胆囊动脉多从肝右支即肝右动脉(B对)发出。